细胞外液中的主要阴离子是
A. HCO₃⁻阴离子
B. SO₄²⁻
C. CL⁻
D. HPO₄²⁻
E. 蛋白质

正确答案：C。CL⁻

解析：组织间液和血浆的电解质中，阳离子主要是Na＋，其次是K＋、Ca2＋、Mg2＋等，阴离子主要是Cl－（C对），其次是HCO3－（A错），HP04 2－（D错） ，SO4 2－（B错）及有机酸和蛋白质（E错）。